不属于阿片类镇痛药的是
B. 枸橼酸芬太尼
C. 盐酸纳洛酮
D. 酒石酸布托啡诺
E. 苯噻啶

正确答案：E。苯噻啶

解析：本题考查药物类型。不属于阿片类镇痛药的是苯噻啶（E错，为本题正确答案）。苯噻啶是抗组胺药，不属于阿片类镇痛药，在临床上主要用于防止复发性血管性头痛，包括典型和非典型性偏头痛等。盐酸美沙酮（A对）、枸橼酸芬太尼（B对）、盐酸纳洛酮（C对）、酒石酸布托啡诺（D对）都是阿片类镇痛药。